NK细胞杀伤肿瘤细胞是通过
A. 特异性地识别肿瘤细胞表面的MHCⅠ类分子
B. 将肿瘤细胞内化杀伤
C. 释放穿孔素
D. 释放TNF-β
E. 释放IFN-α

正确答案：C。释放穿孔素